下述药物之间能产生有益相互作用的是
A. 呋塞米+链霉素
B. 氢氯噻嗪+链霉素
C. 氢氯噻嗪+利血平
D. 呋塞米+庆大霉素
E. 氢氯噻嗪+庆大霉素

正确答案：C。氢氯噻嗪+利血平

解析：本题考查药物的相互作用。下述药物之间能产生有益相互作用的是氢氯噻嗪+利血平（C对）。利尿药（如氢氯噻嗪）与降压药（如利血平）合用能使降压作用加强。呋塞米+链霉素（A错）、氢氯噻嗪+链霉素（B错）可增加耳毒性和肾毒性。呋塞米+庆大霉素（D错）、氢氯噻嗪+庆大霉素（E错）可增加耳毒性。